从新鲜的植物中提取原生苷时应注意考虑的是
A. 苷的溶解性
B. 苷的极性
C. 成元的稳定性
D. 苷的酸水解特性
E. 植物中存在的酶对苷的水解特性

正确答案：E。植物中存在的酶对苷的水解特性

解析：本题考查的是苷类的酶催化水解。从新鲜的植物中提取原生苷时应注意考虑的是植物中存在的酶对苷的水解特性（E对）。植物体内含有苷也含有水解这种苷的酶，但在未损伤的植物组织中，底物和水解酶是完全分隔开的。因此如果想从植物中得到更多的苷元，有时可以考虑利用植物本身所含有的酶对苷进行水解。但要提取制备原存在形式的糖和苷类，则必须设法抑制或破坏酶的活性。